既有祛痰作用，还有酸化尿液、纠正代谢性碱中毒作用的药物是
A. 乙酰半胱氨酸
B. 氯化铵
C. 氨溴索
D. 右美沙芬
E. 可待因

正确答案：B。氯化铵

解析：本题考查氯化铵的药理作用。氯化铵（B对）可用于干咳以及痰不易咳出、酸化尿液、纠正代谢性碱中毒等。